关于基因表达的叙述，错误的是
A. 所有基因表达都经历转录和翻译过程
B. 某些基因表达经历转录和翻译过程
C. 某些基因表达产物是蛋白质分子
D. 某些基因表达产物不是蛋白质分子
E. 某些基因表达产物是RNA分子

正确答案：A。所有基因表达都经历转录和翻译过程

解析：在一定的调节机制下，大多数基因经历转录和翻译过程（B对），并非所有基因表达都经历转录和翻译过程（A错，为本题正确答案）。在基因表达的过程中，蛋白质的编码基因，基因表达产物是蛋白质分子（C对）；rRNA、tRNA的编码基因，基因表达产物是RNA分子（DE对）。